丹参的功效有
A. 活血通经
B. 凉血消痈
C. 祛瘀止痛
D. 清心除烦
E. 疏肝解郁

正确答案：A、B、C、D。活血通经；凉血消痈；祛瘀止痛；清心除烦

解析：本题考查的是丹参的功效。丹参的功效有活血通经（A对）、凉血消痈（B对）、祛瘀止痛（C对）与清心除烦（D对）。丹参：【功效】活血祛瘀，通经止痛，清心除烦，凉血消痈。月季花：【功效】活血调经，疏肝解郁（E错）。